女，29岁。3个月前剖宫产分娩，现行母乳喂养。首选的避孕方式是
A. 口服避孕药
B. 阴茎套
C. 宫内节育器
D. 安全期避孕
E. 体外排精

正确答案：B。阴茎套

解析：该患者在哺乳期，避孕药能抑制乳汁分泌，因此不应选择口服避孕药（A错）。该患者3个月前剖宫产分娩，宫内节育器可能会引起感染，因此不适合选择宫内节育器（C错）。安全期避孕（P381）是根据女性生殖生理的知识推测排卵日期，在判断周期中的易受孕期进行禁欲而达到避孕目的，此法并不十分可靠，因此不宜推广（D错）。体外排精（E错）是指在性生活时，即将发生射精时，将阴茎抽出，使精液射在女方体外的一种方式，主要的失败原因是在射精的瞬间，若男方不能及时的抽出阴茎，会使一部分精液射在阴道内，从而导致女方怀孕，具有不可靠性。阴茎套避孕（B对）是在每次性交时使用阴茎套，安全且正确避孕率高，是首选的避孕方式。